可影响分子间的电荷分布、脂溶性及药物作用时间的吸电子基团是
A. 卤素
B. 羟基
C. 硫醚
D. 酰胺基
E. 烷基

正确答案：A。卤素

解析：本题考查药物结构中的取代基对生物活性影响。卤素（A对）属于强吸电子基，可影响电荷分布、增强脂溶性，延长药物作用时间。引入羟基（B错）可增加药物亲水性，增强与受体的结合能力。硫醚（C错）含有孤对电子、在体内可氧化成亚砜或砜。酰胺（D错）可与生物大分子形成氢键，增强与受体的结合能力。